一患者被人用刀划伤面部软组织，耳前区皮肤有长约6cm的纵行创口，创缘整齐，有活动出血。本病例不会损伤的重要结构是
A. 腮腺腺体
B. 面神经分支
C. 上颌骨
D. 腮腺导管
E. 面静脉和面动脉

正确答案：C。上颌骨

解析：本题考查口腔颌面部的损伤。耳前受伤一般不会损伤上颌骨（C错，为本题的正确答案）。上颌骨的上面参与构成眼眶的下壁，下面参与构成口腔顶部，其内侧面参与构成鼻腔的外侧壁，其后下部分呈粗糙之圆形隆起称为上颌结节，上牙槽后神经、血管由此进入上颌骨内。患者被人用刀划伤面部软组织，耳前区皮肤有长约6cm的纵行创口，创缘整齐，有活动出血（符合切割伤的临床表现）。耳前区受伤易损伤腮腺腺体（A对）；面神经分支（B对）；腮腺导管（D对）；面静脉和面动脉（E对）。